睡眠中发作。2小时来疼痛剧烈，不能缓解，向胸部及后背部放射。伴憋闷，大汗。[假设信息]该患者在心肌梗死后4周，心电图ST段仍持续升高，未回到等电位线，应考虑的并发症是
A. 再发心肌梗死
B. 梗死面积扩大
C. 急性心包炎
D. 室壁瘤形成
E. 梗死后再发心肌缺血

正确答案：D。室壁瘤形成

解析：中年男性患者，一年来每于剧烈活动或饱餐后发作性剑突下疼痛（心绞痛常见诱因），向咽部放射，数分钟可自行缓解（提示既往存在心绞痛，存在发生急性心肌梗死的危险）。近期发作频繁且有夜间睡眠中发作（提示病情加重），2小时来疼痛剧烈，不能缓解（心肌梗死的疼痛特点），向胸部及后背放射，伴憋闷，大汗，综合该患者的病史、体查，该患者首先考虑的诊断是急性心肌梗死。患者在4周后，ST段仍抬高，未回到等电位线，因考虑的并发症是室壁瘤形成（D对）。急性心肌梗死后并发室壁瘤的概率为5～20%，常于起病数周后发现，查体可见左心界扩大，心电图特点为ST段持续抬高不降（一般心梗后ST段抬高时间持续数日至2周左右，后逐渐回到基线水平），B超检查见室壁搏动减弱或反常搏动。再发心肌梗死（A错）指急性心肌梗死4周后再次发生的心梗，心电图主要表现为出现新的Q波或原有Q波加深，ST段有动态性改变而非持续原来水平。梗死面积扩大（B错）一般发生在急性心梗后2～3周内。急性心包炎（302）（C错）可发生于心梗后数周至数月内，患者主要表现为胸骨后、心前区疼痛，伴心包摩擦音，心电图检查见ST段弓背向下抬高，aVR及V1导联ST段压低。梗死后再发心肌缺血（E错）的心电图主要为缺血性改变，常见ST段压低，可伴T波倒置。